关于氯解磷定用于中重度有机磷酸酯类中毒的解救，错误的是
A. 是胆碱酯酶复活药的首选药
B. 制成注射剂供肌内或静脉注射
C. 剂量过大会加剧中毒程度
D. 能直接对抗体内Ach
E. 需较大剂量才对中枢中毒症状有一定疗效

正确答案：D。能直接对抗体内Ach

解析：氯解磷定水溶性好，溶液较稳定，无刺激性，可以肌内注射或静脉注射（B对），两种给药途径疗效相当。由于其使用方便，不良反应少，价格低廉，故为临床使用的首选药（A对）。主要用于中、重度有机磷酸酯类中毒的解救。对不同的有机磷酸酯类中毒疗效存在差异。氯解磷定恢复胆碱酯酶活性的作用在骨骼肌神经肌肉接头处最为明显，可使肌束颤动明显减轻或消失；因不易透过血脑屏障，故需较大剂量才对中枢中毒症状有一定疗效（E对）；不能直接对抗体内已积聚的Ach（D错，为本题正确答案），必须与阿托品合用才能有效解除M样症状。不良反应少见，偶有轻度头痛、眩晕、恶心、呕吐等。剂量过大，可直接与胆碱酯酶结合而抑制其活性，加剧中毒程度（C对）。